关于同工酶的叙述哪一项是正确的
A. 酶分子的一级结构相同
B. 催化的化学反应相同
C. 各同工酶Km相同
D. 同工酶的生物学功能可有差异
E. 同工酶的理化性质相同

正确答案：B。催化的化学反应相同